以下哪项是最重要的与HIV感染密切相关的口腔病变
A. 卡波西肉瘤
B. 卡氏肺孢子囊虫
C. 坏死性龈炎
D. 口腔毛状白斑
E. 非霍奇金淋巴瘤

正确答案：D。口腔毛状白斑

解析：口腔毛状白斑是最重要的与HIV感染密切相关的口腔病变。为发生于口腔黏膜的白色毛绒状病变。掌握“艾滋病的口腔表现”知识点。